2周岁的小儿的标准体重、身高按现行公式计算应为
A. 12公斤、85厘米
B. 14公斤、105厘米
C. 16公斤、110厘米
D. 18公斤、115厘米
E. 20公斤、112厘米

正确答案：A。12公斤、85厘米

解析：本例儿童年龄为2岁，故可以运用上述公式，身高（cm）=7×2+75=89（旧教材公式：身高（cm）=5×2+75=85或身高（cm）=7×2+70=84），体重（kg）=8+2×2=12，由于本题出题年份较早，故身高按照旧公式可得该儿童的标准体重、身高为12kg，85cm（A对）。